容易折断并发根尖周病的是
A. 牙中牙
B. 畸形舌侧尖
C. 畸形舌侧窝
D. 畸形根面沟
E. 畸形中央尖

正确答案：B。畸形舌侧尖

解析：本题考查畸形中央尖。容易折断并发根尖周病的是畸形舌侧尖（B对）。畸形舌侧尖易遭磨损而引起牙髓及根尖周组织病变。牙中牙（A错）：是牙内陷最严重的一种。牙呈圆锥状，且较其固有形态稍大，X线片示其深入凹陷部好似包含在牙中的一个小牙，其实陷入部分的中央不是牙髓，而是含有残余成釉器的空腔。畸形舌侧窝（C错）：由于舌侧窝呈囊状深陷，容易滞留食物残渣，利于细菌滋生，再加上囊底存在发育上的缺陷，常易引起牙髓的感染、坏死及根尖周病变。畸形根面沟（D错）：使龈沟底封闭不良，上皮在该处呈病理性附着，并形成骨下袋，成为细菌、毒素入侵的途径，易导致牙周组织的破坏。畸形中央尖（E错）：中央尖折断或被磨损后，临床上表现为圆形或椭圆形黑环，中央有浅黄色或褐色的牙本质轴，在轴中央有时可见到黑色小点，此点就是髓角，但在此处即使用极细的探针也不能探入。圆锥形中央尖，萌出后不久与对颌牙接触，即遭折断，使牙髓感染坏死，影响根尖的继续发育。